排钾利尿药与地高辛相互作用引起心律失常，这是一种
A. 在受体上的协同作用
B. 在受体上的相加作用
C. 在不同受体或作用点的协同作用
D. 在不同受体或作用点的相加作用
E. 敏感化现象

正确答案：E。敏感化现象

解析：本题考查药物的相互作用。敏感化现象（E对）是指一种药物可使组织或受体对另一种药物的敏感性增强，如排钾利尿剂与地高辛相互作用就是因为前者使血浆钾离子浓度降低，心脏对地高辛的敏感性增强，发生心律失常。在受体上的协同作用（A错）和在受体上的相加作用（B错）是一个概念，即两种药物作用于同一受体，产生相互叠加的作用。在不同受体或作用点的协同作用（C错）和在不同受体或作用点的相加作用（D错）是一个概念，分别作用于不同的受体，产生协同或相加作用。